男，31岁，精神分裂症急性发作入院，因兴奋躁动，敌对攻击严重。给予氟哌啶醇5mg，一天2次肌肉注射。次日患者出现双眼上翻，斜颈，面肌肉痉挛，角弓反张。此时首选的处理方法是
A. 立即停药
B. 口服普萘洛尔
C. 口服苯二氮䓬类药物
D. 电抽搐治疗
E. 肌肉注射东莨菪碱

正确答案：E。肌肉注射东莨菪碱

解析：氟哌啶醇为第一代抗精神病药物，容易引起锥体外系不良反应，如急性肌张力障碍，表现为眼上翻、斜颈、面肌痉挛、角弓反张、张口困难、脊柱侧弯等。急性肌张力障碍是由于氟哌啶醇拮抗了黑质纹状体通路的D₂样受体，使纹状体中的多巴胺功能减弱、乙酰胆碱的功能增强而引起的，当出现轻微的急性肌张力障碍，可以减少药量或停药，症状可减轻或自行消除，当症状严重时，需要使用胆碱能受体阻断药（东莨菪碱、苯海索）或促进DA释放的药物（金刚烷胺）缓解锥体外系反应。本例患者的锥体外系反应较重，最合理的处理是使用胆碱能受体阻断药（东莨菪碱）尽快缓解锥体外系反应（E对A错）。口服普萘洛尔（B错）、口服苯二氮䓬类药物（C错）适用氟哌啶醇所致的静坐不能。电抽搐治疗（D错）与氟哌啶醇一样，属于精神分裂症的治疗方法。